既能抑制环氧合酶（COX），又能抑制脂氧合酶药物是
A. 吲哚美辛
B. 双氯芬酸钠
C. 舒林酸
D. 奈丁美酮
E. 芬布芬

正确答案：B。双氯芬酸钠

解析：本题考查芳基乙酸类非甾体抗炎药的特点。双氯芬酸钠（B对）为芳基乙酸类非甾体抗炎药，除了能够抑制COX，减少前列腺素的生物合成和血小板的生成，还能抑制脂氧合酶，减少白三烯的生成，这种双重的抑制作用能够避免由于单纯抑制COX而导致脂氧合酶活性突增而引起的不良反应。